针对地方政府、卫生部门对健康教育工作的重视程度以及投人的资源情况的评估属于
A. 社会诊断
B. 教育诊断
C. 流行病学诊断
D. 行为与环境诊断
E. 管理与政策诊断

正确答案：E。管理与政策诊断